良好的医患关系的作用是
A. 有利于诊断和治疗
B. 有利于实施预防措施
C. 有利于病人的情绪
D. 有利于医务人员的健康
E. 以上都是

正确答案：E。以上都是